调节生殖系统的发育及月经周期
A. 肾上腺皮质
B. 肾上腺髓质
C. 胸腺
D. 松果体
E. 垂体

正确答案：D。松果体

解析：松果体（D对）合成和分泌褪黑素，间接影响性腺的发育。褪黑素参与调节生殖系统的发育、月经周期的节律和许多神经功能活动。在儿童期，松果体病变引起其功能不全时，可出现性早熟或生殖器官过度发育。